治疗梅毒，湿热疮毒，应选用的药物是
A. 硫黄
B. 白鲜皮
C. 秦皮
D. 土茯苓
E. 乌梅

正确答案：D。土茯苓

解析：土茯苓甘淡，解毒利湿，通利关节，又兼解汞毒，故可用治梅毒或因梅毒服汞剂中毒而致肢体拘挛、筋骨疼痛者，为治梅毒要药。本品甘淡渗利，解毒利湿，适用于湿热引起的热淋、带下、疥癣、湿疹、湿疮（D对）。硫黄的功效为外用解毒疗疮、杀虫止痒；内服补火助阳通便。治疗疥癣，秃疮，湿疹，阴疽恶疮；阳痿足冷，虚喘冷哮，虚寒便秘（A错）。白鲜皮的功效为清热燥湿，祛风解毒。治疗湿热疮毒，黄水淋漓，湿疹，风疹，疥癣疮癞；湿热黄疸尿赤，风湿热痹（B错）。秦皮的功效为清热燥湿，收涩止痢，止带，明目。治疗湿热泻痢，赤白带下；肝热目赤肿痛，目生翳膜（C错）。乌梅的功效为敛肺，涩肠，生津，安蛔。治疗肺虚久咳；久泻久痢；虚热消渴；蛔厥呕吐腹痛（E错）。